全天麻胶囊的功能有
A. 补血
B. 平肝
C. 息风
D. 止痉
E. 安神

正确答案：B、C、D。平肝；息风；止痉